诊断为肺栓塞。使用阿替普酶溶栓。同时给予抗凝等治疗。阿替普酶适宜的给药剂量是
A. 30mg
B. 50mg
C. 150mg
D. 100mg
E. 10mg

正确答案：D。100mg

解析：本题考查阿替普酶的常规剂量。阿替普酶的常规剂量为100mg（D对）。对于心肌梗死症状发生在6h内的患者，首先15mg静脉注射，随后30min持续静脉滴注50mg，最后剩余的35mg，60min内持续静脉滴注。